膀胱经的郄穴是
A. 中都
B. 外丘
C. 梁丘
D. 地机
E. 金门

正确答案：E。金门

解析：该题考查十六经脉的郄穴。中都为足厥阴肝经的郄穴（A错）。外丘为足少阳胆经的郄穴（B错）。梁丘为足阳明胃经的郄穴（C错）。地机为足太阴脾经的郄穴（D错）。金门为足太阳膀胱经的郄穴（E对）。